下列栓剂中发挥局部治疗作用的是
A. 阿司匹林栓
B. 甲硝唑栓
C. 对乙酰氨基酚栓
D. 吲哚美辛栓
E. 氨茶碱栓

正确答案：B。甲硝唑栓